中枢作用强的M胆碱受体拮抗剂药物是
A. 异丙托溴铵
B. 东莨菪碱
C. 山莨菪碱
D. 丁溴东莨菪碱
E. 噻托溴铵

正确答案：B。东莨菪碱

解析：本题考查M胆碱受体拮抗药的作用特点。东莨菪碱（B对）是一种颠茄类生物碱，治疗剂量时即可致中枢神经系统抑制，具有明显的镇静作用，表现为困倦、遗忘、疲乏、快速动眼睡眠相缩短，但在大剂量时却又产生兴奋作用。此外尚有欣快作用，因此易造成药物滥用。